儿童生理性补液为
A. 2：3：1含钠液
B. 4：3：2含钠液
C. 2：1等张含钠液
D. 1：3含钠液
E. 1：4含钠液

正确答案：E。1：4含钠液

解析：儿童生理性补液为1：4含钠液（E对）。